能燥湿化痰的药是
A. 香附
B. 青皮
C. 川楝子
D. 荔枝核
E. 化橘红

正确答案：E。化橘红

解析：本题考查的是化橘红的功效。能燥湿化痰的药是化橘红（E对）。化橘红：【功效】理气宽中，燥湿化痰，消食。香附（A错）：【功效】疏肝理气，调经止痛。青皮（B错）：【功效】疏肝破气，消积化滞。川楝子（C错）：【功效】行气止痛，杀虫，疗癣。荔枝核（D错）：【功效】行气散结，祛寒止痛。